目前治疗SLE的诱导缓解期的首选药物是
A. 非甾体抗炎药
B. 氯喹或羟氯喹
C. 雷公藤多甙
D. 环磷酰胺
E. 泼尼松

正确答案：E。泼尼松

解析：SLE为一种有多系统损害的慢性自身免疫性疾病，目前尚不能根治，肾上腺皮质激素加免疫抑制剂依然是主要的治疗方案，其中诱导缓解期首选药物是泼尼松（E对）。而非甾体抗炎药（A错）常用于SLE的患者患有发热及关节痛的对症治疗，氯喹或羟氯喹（B错）、雷公藤总苷（C错）、环磷酰胺（D错）均为免疫抑制剂，多用于SLE患者病情活动时，有利于更好的控制SLE活动，保护重要脏器功能，减少复发，但非最常用的基础治疗药物。